听觉传导路不经过下述哪个结构
A. 前庭蜗神经
B. 斜方体
C. 内侧丘系
D. 下丘臂
E. 内侧膝状体

正确答案：C。内侧丘系

解析：听觉传导通路的第1级神经元为蜗神经节内的双极神经细胞。第2级神经元胞体在蜗腹侧核和蜗背侧核内，形成外侧丘系（C错，为本题正确选项）。第3级神经元胞体在下丘核。第4级神经元胞体在内侧膝状体，发出纤维组成听辐射。可以概括为：声音→耳廓→外耳道→鼓膜→中耳→前庭窃→内耳→螺旋器→蜗神经→蜗神经核→斜方体（B对）→外侧丘系→下丘→下丘脑（D对）→内侧膝状体（E对）→听辐射→内囊后肢→颞横回→额中回后部（书写中枢）和额上回后部（听觉性语言中枢)。